临床试验应符合的原则是
A. 公平原则
B. 分组原则
C. 平等原则
D. 随机原则
E. 尊重原则

正确答案：D。随机原则

解析：本题考查口腔临床试验方法。临床试验与其他流行病学方法相比有其特点。其设计应符合三个基本原则，即随机（D对）、对照和盲法。